围产儿预后相对较好的臀先露是
A. 单足先露
B. 混合臀先露
C. 单臀先露
D. 单膝先露
E. 双膝先露

正确答案：C。单臀先露

解析：臀位分娩对围产儿影响较大，并发症较多，其中脐带脱垂严重影响围产儿的预后情况。臀位的脐带脱垂发生率约为4%～5%，为头位的10倍，其中先露部填满了宫颈口的单臀先露（C对）的脐带脱垂发生率较低，仅在1%左右；混合臀先露（B错）为2%～5%；单足先露（A错）则因所露出的空隙最大而高达10%～18%；不完全臀先露（包括单足先露，单膝先露（D错），双膝先露（E错））危害都较大（实用妇产科学第2版P435）。